正胜邪退指
A. 阳胜则阴病
B. 阳损及阴
C. 二者均是
D. 二者均非

正确答案：D。二者均非

解析：本题考查的是邪正盛衰病机的内容。正胜邪退指病势好转或向愈（D对）。邪正盛衰的病机，是指在疾病过程中，机体的抗病能力与致病邪气之间相互斗争中所发生的盛衰变化。在疾病的发展过程中，邪正的消长盛衰变化决定病机、病证的虚实夹杂或转化。一般规律是，正盛邪退则病势好转或向愈，邪去正虚则病愈而体虚，正虚邪恋则病势缠绵迁延而难愈，邪盛正衰则病势恶化，甚则死亡。阳胜则阴病（A错）属于阳盛。“阳胜则阴病”，即阳盛则阴虚。但从病机上必须区分阴的虚损程度。邪客于阳而致阳盛，此时由于阴的相对不足，从而出现实热证。如果由于阳盛而耗伤机体的阴液，此时阴由相对的不足转而成为绝对的虚亏，这就从实热证转化为虚热证或实热兼阴亏证。阳损及阴（B错）属于阴阳互损。阳损及阴，是指由于阳气虚损，无阳则阴无以生，从而在阳虚的基础上又导致了阴虚，形成以阳虚为主的阴阳两虚的病机变化。